眼球内容物包括
A. 房水
B. 晶状体
C. 玻璃体
D. 以上都是
E. 以上都不是

正确答案：D。以上都是

解析：眼球内容物包括房水（A对）、晶状体（B对）和玻璃体（C对），故选择“以上都是（D对）”。